根据《执业药师资格制度暂行规定》，执业药师的职责包括
A. 负责处方的审核及监督调配
B. 负责提供用药咨询与信息
C. 负责指导合理用药
D. 负责上岗人员的药学知识培训
E. 负责本单位的质量管理

正确答案：A、B、C、E。负责处方的审核及监督调配；负责提供用药咨询与信息；负责指导合理用药；负责本单位的质量管理

解析：本题考查的是执业药师的职责。根据《执业药师资格制度暂行规定》，执业药师的职责包括负责处方的审核及监督调配（A对）、负责提供用药咨询与信息（B对）、负责指导合理用药（C对）、负责本单位的质量管理（E对）。执业药师岗位职责：执业药师是经过国家职业资格认证的药学技术人员，是保障药品质量和用药安全、合理的重要技术力量，执业药师的执业行为直接关系到药品质量和药学服务质量，直接关系到药品监管政策实施效果。根据《中共中央国务院关于深化医药卫生体制改革的意见》（中发〔2009〕6号），执业药师的主要岗位职责包括指导合理用药与药品质量管理。《药品管理法》规定，从事药品经营活动的药品经营企业和医疗机构应当配备有依法经过资格认定的药师或者其他药学技术人员。药品经营企业执业药师在企业内负责药品管理、处方审核和调配、合理用药指导等工作。医疗机构执业药师负责本单位的药品管理、处方审核和调配、合理用药指导等工作，非药学技术人员不得直接从事药剂技术工作。《中华人民共和国药品管理法实施条例》（以下简称《药品管理法实施条例》）规定，经营处方药、甲类非处方药的药品零售企业，应当配备执业药师或者其他依法经资格认定的药学技术人员。《药品经营质量管理规范》规定药品经营企业关键岗位必须配备执业药师，具体内容见第四章药品经营管理。12号文进一步明确执业药师职责包括药品质量管理与指导合理用药。执业药师在执业范围内负责对药品质量的监督和管理，参与制定和实施药品全面质量管理制度，参与单位对内部违反规定行为的处理工作。执业药师负责处方的审核及调配，提供用药咨询与信息，指导合理用药，开展治疗药物监测及药品疗效评价等临床药学工作。